浅龋与釉质钙化不全相比较，在探诊方面明显的区别是
A. 病损部位的光滑度
B. 病损部位的颜色
C. 病损的好发部位
D. 病损的对称性出现
E. 病损的遗传特性

正确答案：A。病损部位的光滑度

解析：本题考查浅龋与釉质钙化不全的鉴别诊断。浅龋与釉质钙化不全相比较，在探诊方面明显的区别是病损部位的光滑度（A对）。浅龋损害部位探诊较毛糙，而釉质发育不全局部探诊光滑。